男，43岁。右下后牙固定义齿修复2年，松动，咬合不适。查：45、44缺失，46～43固定桥，43的3/4冠固位体松动，龋坏，46全冠固位体未见异常。43固位体松动的原因是
A. 桥体过长
B. 咬合力过大
C. 固位力不均衡
D. 基牙松动
E. 基牙支持力不足

正确答案：C。固位力不均衡

解析：本题考查固定义齿松动的原因。患者右下后牙固定义齿修复2年，松动，咬合不适。检查可知45、44缺失（非游离端缺失），46～43固定桥（双端固定桥），43的3/4冠固位体松动，龋坏（一端松动龋坏，固位力变差），46全冠固位体未见异常（一端稳固）。43固位体松动的原因是固位力不均衡（C对）。少一个基牙导致固位体松动。咬合力过大（B错）可能伤及牙周组织。桥体过长（A错）可能导致桥体弯曲下沉。基牙松动（D错）可通过调牙合以减轻负担，但不会导致固位体松动。基牙支持力不足（E错）应考虑更换支持条件较好的基牙。